女，35岁。误服有机磷农药50ml，立即被其家人送往医院，该病人抢救成功的关键是
A. 彻底洗胃
B. 早期应用解磷定
C. 早期应用阿托品
D. 解磷定与阿托品合用
E. 静脉注射西地兰

正确答案：A。彻底洗胃

解析：有机磷中毒抢救成功的关键是迅速清除尚未被人体吸收的毒物，患者为口服中毒，首选彻底洗胃（A对）减少毒物吸收，降低毒性作用。解磷定、阿托品分别是ChE复能药和胆碱受体拮抗药，用于有机磷农药吸收后对抗患者的中毒症状及恢复胆碱酯酶活性，但非首要关键措施（BCD错）。西地兰（E错）用于中毒患者已出现严重心律失常时的对症治疗。